患者，女，58岁，心房颤动病史多年，既往服用华法林，因INR值波动大，反复出现牙出血后停用。症状缓解后医师建议恢复口服抗凝治疗，但患者拒绝再用华法林。宜选用的药物是
A. 替格瑞洛
B. 氯吡格雷
C. 西洛他唑
D. 双嘧达莫
E. 达比加群酯

正确答案：E。达比加群酯

解析：本题考查达比加群酯。宜选用的药物是达比加群酯（E对）。不能用华法林的患者，可选用新型口服抗凝药物包括直接凝血酶抑制剂达比加群酯、Xa因子抑制剂利伐沙班与阿哌沙班。替格瑞洛（A错）、氯吡格雷（B错）、西洛他唑（C错）、双嘧达莫（D错）都是抑制血小板聚集药物。